胸导管
A. 注入左静脉角
B. 收集上半身的淋巴
C. 收集右上半身的淋巴
D. 注入右静脉角
E. 穿膈的主动脉裂孔入胸腔后一直沿脊柱左侧上行

正确答案：A。注入左静脉角

解析：胸导管引流左侧上半身和下肢的淋巴（BC错），穿过主动脉裂孔进入胸腔后，首先沿脊柱右前方上行（E错），至第5胸椎高度斜行后再沿脊柱左侧上行，而后在左颈总动脉和左颈内静脉后方转向前内下方，注入左静脉角（A对D错）。